使外来化学物易于经生物膜简单扩散的因素为
A. 浓度梯度大，脂水分配系数高，非解离状态
B. 浓度梯度大，脂水分配系数低，解离状态
C. 浓度梯度大，脂水分配系数低，非解离状态
D. 浓度梯度小，脂水分配系数高，分子大
E. 浓度梯度小，脂水分配系数高，分子小

正确答案：A。浓度梯度大，脂水分配系数高，非解离状态